急性持续性疼痛阵发性加剧并休克，最可能的疾病是
A. 急性阑尾炎
B. 绞窄性肠梗阻
C. 泌尿结石，肾绞痛
D. 外伤性肝破裂
E. 急性单纯性肠梗阻

正确答案：B。绞窄性肠梗阻

解析：急性持续性腹痛，阵发性加剧并伴休克情况下，最可能的疾病是绞窄性肠梗阻（B对）。绞窄性肠梗阻时由于梗阻的肠段急性缺血、坏死，患者多表现为持续性腹痛，当肠内容物通过梗阻肠段时可加重腹痛；肠壁血运障碍，毛细血管通透性增加，大量渗出液渗入肠腔和腹腔，使血容量下降，严重者可出现休克。急性阑尾炎（A错）发病较缓，腹痛发作始于上腹，逐渐移向脐部，后转移并局限在右下腹，即转移性右下腹疼痛。泌尿系结石（P558）可出现肾绞痛，表现为阵发性腰部或上腹部疼痛，疼痛剧烈难忍，可沿输尿管行径放射至同侧腹股沟，一般不出现休克（C错）。外伤性肝脏破裂（D错）最主要的表现为失血性休克，可有持续性腹痛，但不伴阵发性加剧。急性单纯性肠梗阻（E错）的腹痛呈阵发性绞痛，由于肠管无血运障碍，体液丢失少，一般不出现休克。